能引起大便颜色变黑的药物是
A. 兰索拉唑
B. 多潘立酮
C. 枸橼酸铋钾
D. 法莫替丁
E. 硫糖铝

正确答案：C。枸橼酸铋钾

解析：本题考查枸橼酸铋钾的不良反应。能引起大便颜色变黑的药物是枸橼酸铋钾（C对）。枸橼酸铋钾主要不良反应是黑便，大量长期服用可有脑、肾毒性。质子泵抑制剂如兰索拉唑（A错），长期服用影响钙吸收，可致骨质疏松。多潘立酮（B错）可引起Q-T间期延长，导致心律失常，因此不宜与酮康唑口服制剂、红霉素或其他可能延长Q-T间期的CYP3A4酶强抑制剂（如氟康唑、伏立康唑、克拉霉素、胺碘酮、泰利霉素等）联用。法莫替丁（D错）不良反应可使驾驶员出现定向力障碍。硫糖铝（E错）主要的不良反应为便秘，偶见口干、恶心、腹泻等，长期服用可导致低磷血症。